男，60岁。1小时前突发呕血500ml，既往有慢性乙肝病史。查体：P105次/分，BP95/70mmHg，轻度烦躁。目前首要的处理是
A. 输注胶体扩容
B. 输注晶体扩容
C. 输红细胞悬液
D. 应用止血药
E. 输全血

正确答案：B。输注晶体扩容

解析：老年患者，既往慢性乙肝病史，突发呕血500ml，查体：P105次/分（正常值为60～100次/分，心率稍快），BP95/70mmHg（正常值为90～140/60～90mmHg），轻度烦躁，根据输血原则失血最达总血容量的10% -20% （500～1000ml）时，病人心率增快，可先输入适量晶体液扩容（B对），保护肝肾功能，在输入胶体扩容（A错），防治病情进一步加重。若失血量超过总血容量 20%（1000ml）时，除有较明显的血容量不足、血压不稳定外，还可出现HCT下降。此时，除输入晶体液或胶体液补充血容量外，还应适当输入红细胞悬液（C错）以提高携氧能力。当失血量超过30%时，可输全血（E错）与CRBC各半，再配合晶体和胶体液及血浆以补充血容量。消化道出血时应首先积极补充血容量，在患者体征稳定的情况下进一步查明病因，若有继续出血的情况可针对性应用止血药（D错）。